X线片显示正常骨组织被纤维组织代替，且颌骨外形膨大，牙周组织骨硬板消失，但牙周膜间隙正常。考虑为
A. 嗜酸性肉芽肿
B. 汉-许-克病
C. 骨纤维异常增殖症
D. 局限性侵袭性牙周炎
E. 糖尿病性牙周炎

正确答案：C。骨纤维异常增殖症

解析：本题考查骨纤维异常增殖症。X线片显示正常骨组织被纤维组织代替，且颌骨外形膨大，牙周组织骨硬板消失，但牙周膜间隙正常。考虑为骨纤维异常增殖症（C对）。骨纤维异常增殖症又称为骨纤维结构不良，特征是正常骨组织被显微组织所替代，当病变累及牙周组织时，常使牙周骨硬板影响模糊或消失，但牙周膜间隙一般仍存在。而且骨纤维异常增殖症也有明显的沿颌骨外形膨大的特点。